由于对颌天然牙硬度大、（牙合）力大，选择义齿人工牙时最好选用
A. 瓷牙
B. 塑料牙
C. 软树脂牙
D. 金属（牙合）面牙
E. 树脂（牙合）面牙

正确答案：D。金属（牙合）面牙

解析：本题考查单颌全口义齿。单颌全口义齿修复要点：由于对颌天然牙硬度大、（牙合）力大，义齿人工牙磨耗快。因此，在选择义齿人工牙时最好选用质地较硬、耐磨的硬质树脂牙，或采用金属（牙合）面牙（D对）。